人类大量使用氯氟烃（CFCs）造成的全球环境问题主要是
A. 气候变暖导致冰川融化等生态破坏
B. 臭氧层破坏
C. 形成酸雨，破坏生态系统
D. 生物多样性锐减
E. 植被破坏，导致沙漠化

正确答案：B。臭氧层破坏

解析：本题考查臭氧层破坏。氟利昂等消耗臭氧物质是臭氧层破坏（B对ACDE错）的元凶，氟利昂是本世纪20年代合成的，其化学性质稳定，不具有可燃性和毒性，被当作制冷剂、发泡剂和清洗剂，广泛用于家用电器、泡沫塑料、日用化学品、汽车、消防器材等领域。